根据黄疸发生的原因分为
A. 溶血性黄疸、肝细胞性黄疸
B. 溶血性黄疸、阻塞性黄疸
C. 肝细胞性黄疸、阻塞性黄疸
D. 溶血性黄疸、肝细胞性黄疸和阻塞性黄疸
E. 隐性黄疸、显性黄疸

正确答案：D。溶血性黄疸、肝细胞性黄疸和阻塞性黄疸

解析：根据黄疸发生的原因可将黄疸分为溶血性黄疸、肝细胞性黄疸和阻塞性黄疸。各种黄疸均有其独特的血、尿、粪胆色素实验室检查改变。掌握“胆色素代谢”知识点。